下列可以鉴别心绞痛和心肌梗死的是
A. 舌下含服硝酸甘油疼痛是否缓解
B. 疼痛部位
C. 疼痛性质
D. 发病原因
E. 心肌酶检查

正确答案：A。舌下含服硝酸甘油疼痛是否缓解

解析：硝酸甘油对于心绞痛有显著缓解作用，对心肌梗死作用较差或无效（A对）。心绞痛和心肌梗死的疼痛部位基本相同，位于中下段胸骨后，心肌梗死也可在较低位置或上腹部（B错）。两病均表现为压榨性或窒息性疼痛（C错）。以往沿用多年的 AMI 心肌酶测定，包括肌酸激酶 (CK) 天冬氨酸氨基转移酶（AST）以及乳酸脱（LDH）其特异性及敏感性均远不如心肌坏死标志物，目前已不再用于诊断AMI（E错）。